人参的入药部位
A. 根
B. 根及根茎
C. 块茎
D. 鳞茎
E. 球茎

正确答案：B。根及根茎

解析：本题考查的是人参的入药部位。人参的入药部位干燥根和根茎（B对）。人参：【来源】为五加科植物人参的干燥根和根茎。入药部位为根（A错）的中药有牛膝、川牛膝、商陆、银柴胡、白芍、赤芍、板蓝根、地榆、苦参、葛根、粉葛、黄芪、西洋参、白芷、当归等。入药部位为块茎（C错）中药有延胡索、三棱、泽泻、天南星、半夏、天麻、白及等。入药部位为鳞茎（D错）中药有川贝母、浙贝母等。入药部位为球茎（E错）中药，2022年考试指南未明确说明。